（132～135题共用题干）女，30岁。妊娠40周。临产12小时后在产钳助娩下分娩一4100g女婴。胎儿娩出后15分钟胎盘人工剥离取出，检查胎盘无异常，继之发生阴道大量流血。该患者分娩过程中，在胎肩娩出后为防止产后出血应预防性使用
A. 止血药物
B. 缩宫素
C. 抗菌素
D. 输血浆
E. 输血

正确答案：B。缩宫素

解析：胎儿娩出的过程为第二产程，子宫收缩乏力性产后出血的产时预防应尽早使用缩宫素（B对）。止血药物（A错）、输血浆（D错）、输血（E错）均是在发生出血后的处理，不属于预防性处理。抗菌素（C错）一般也是在出现产后出血后，给予大量广谱抗生素，预防感染。